SPA存在于下列哪种细菌
A. 表皮葡萄球菌
B. 腐生葡萄球菌
C. 金黄色葡萄球菌
D. 乙型溶血性链球菌
E. 甲型链球菌

正确答案：C。金黄色葡萄球菌

解析：葡萄球菌A蛋白（SPA）存在于90%以上的金葡菌细胞壁表面，它与IgG1、IgG2和IgG4分子的Fc段非特异性结合，结合后的IgG的Fab段仍能与抗原特异性结合，利用此特性建立的协同凝集试验用于多种微生物抗原的检测。掌握“葡萄球菌属”知识点。